乳头肌断裂致急性二尖瓣关闭不全时，下列描述正确的是
A. 左心室大小无明显变化
B. 可无症状
C. 左心房明显扩大
D. 胸部X线片示肺纹理稀疏
E. 心电图示Sv₁+Rv₅＞4.0mV

正确答案：A。左心室大小无明显变化

解析：急性二尖瓣关闭不全时，左心室血液反流可使左心房容量负荷骤增，随之出现左心房压和肺毛细血管楔压急剧升高，导致肺淤血及急性肺水肿的发生（B错），此时胸部X线片示肺纹理增多、增粗（D错）。由于急性二尖瓣关闭不全一般起病较急，左心房多大小正常或轻度扩大（C错），而左心室一般来不及代偿，大小常无明显变化（A对）。心电图示SVl+RV₅＞4.0mV（E错）为左心室肥厚的表现（九版诊断学P496），而不是增大的表现。